农民患唇红部癌是城市居民的
A. 2倍
B. 3倍
C. 4倍
D. 5倍
E. 6倍

正确答案：A。2倍

解析：光辐射：光辐射（波长320～400nm）是引起皮肤癌的主要原因，长期强烈光照也是唇红部癌的原因之一，多发生在下唇。农民与户外工作人员患病率高，农民患唇红部癌是城市居民的2倍。掌握“口腔癌的预防”知识点。